石棉是属于
A. 遗传毒性致癌物
B. 非遗传毒性致癌物
C. 前致癌物，
D. 直接致癌物
E. 近致癌物

正确答案：B。非遗传毒性致癌物